注射普鲁卡因青霉素+口服丙磺舒治疗敏感菌感染属于
A. 提高药物疗效
B. 减少不良反应
C. 治疗多种疾病
D. 延缓细菌耐药性的产生
E. 加速细菌胞壁破裂

正确答案：A。提高药物疗效